可用Molish反应鉴别的化合物是
A. 麻黄碱
B. 伪麻黄碱
C. 五味子醇甲
D. 葡萄糖
E. 五味子醇乙

正确答案：D。葡萄糖

解析：本题考查的是葡萄糖的鉴别反应。可用Molish反应鉴别的化合物是葡萄糖（D对）。糖的显色反应中最重要的是Molish反应，常用的试剂由浓硫酸和α-萘酚组成。硫酸兼有水解苷键的作用，生成的单糖在浓硫酸的作用下，失去三分子水，生成具有呋喃环结构的醛类化合物。由五碳糖生成的是糠醛，甲基五碳糖生成的是5-甲糠醛，六碳糖生成的是5-羟甲糠醛。这些糠醛衍生物和许多芳胺、酚类可缩合成有色物质，可借此来检识糖和苷类化合物的存在。葡萄糖为六碳糖。麻黄碱（A错）与伪麻黄碱（B错）用二硫化碳-硫酸铜反应与铜络盐反应鉴别。五味子醇甲（C错）与五味子醇乙（E错）为五味子的成分。《中国药典》采用高效液相色谱法测定药材中五味子醇甲的含量。